患者，女性，36岁，乳房内多发性肿块，伴疼痛，月经后有所缩小变软，应首先考虑的诊断是
A. 乳腺增生病
B. 乳腺癌
C. 乳腺纤维腺瘤
D. 积乳囊肿
E. 急性乳腺炎

正确答案：A。乳腺增生病

解析：患者，女性，36岁，本病多发生于30～50岁妇女。乳房内多发性肿块，伴疼痛，月经后有所缩小变软，故诊断为乳腺增生病（A对）。乳腺癌临床见浸润性生长的无痛性乳腺肿块、与皮肤粘连、有乳头血性溢液、较大肿块引起乳腺皮肤水肿、橘皮样变、乳头回缩、患侧乳腺抬高等（B错）。乳腺纤维腺瘤属中医"乳核"范畴，临床特点是乳房肿块，圆形，表面而光滑、质地坚韧、推之移动（C错）。积乳囊肿亦称乳汁潴留囊肿或乳汁郁积症，是妊娠期、哺乳期妇女的良性疾病。哺乳期乳房的某一小叶或导管因故发生堵塞，导致乳汁排出不畅，潴留于导管内，使之扩张形成囊肿，表现为乳房内肿块（D错）。急性乳腺炎的临床特点乳房肿胀疼痛，初起时患乳肿大，胀痛或触痛，翻身或吮乳时痛甚，疼痛部位多在乳房的外下象限。伴乳汁排泄不畅，发热（E错）。